当有必要选择辅助检查时，医生恰当的做法是
A. 全面进行辅助检查，以避免遗漏相关信息
B. 选择必要的辅助检查，以帮助确诊
C. 为了帮助患者节约费用，尽量避免使用辅助检查手段
D. 征求患者的意见，由患者决定
E. 配合相关研究，选择对研究有利的检查方法

正确答案：B。选择必要的辅助检查，以帮助确诊

解析：辅助检查很多时候对疾病的诊断起着关键的作用，在辅助检查中临床医生应根据诊治需要选择必要的检查，尽快确诊病情（B对）。此外医生应当遵守以下伦理要求：（-）诊治需要，目的正当 采用合理且必要的检查方式，综合考量患者的病情及经济情况（AC错）。（二）知清同意，尽职尽责 医生确定了辅助检查的项目以后，一定要向患者和家属讲清楚检查的目的、意义、费用、医疗风险等，让其理解并表示同意后再进行检查，特别是一些比较复杂、费用昂贵或危险性较大的检查更应该得到患者的理解和同意，单并不能完全由患者决定用药（D错）。医生应当以患者为中心，在服务患者的基础上，适当进行相关研究（E错）。